发疹性传染病按皮疹出现先后顺序排列，正确的为
A. 猩红热、天花、水痘
B. 猩红热、风疹、水痘
C. 天花、水痘、猩红热
D. 水痘、天花、猩红热
E. 水痘、猩红热、天花、麻疹

正确答案：E。水痘、猩红热、天花、麻疹

解析：水痘1～2天出疹，猩红热起病第1～2天迟至第五天出疹，天花发病3天出疹，麻疹病程3～4天出疹，正确的发疹性传染病按皮疹出现先后顺序排列为水痘、猩红热、天花、麻疹（E对）。